以下不注入右淋巴导管的淋巴干是
A. 右锁骨下干
B. 右颈干
C. 左支气管纵隔干
D. 右支气管纵隔干
E. 无

正确答案：C。左支气管纵隔干

解析：右颈干（B对）、右锁骨下干（A对）和右支气管纵隔干（D对）都注入右淋巴导管，而身体左侧颈干、锁骨下干和支气管纵隔干以及下半身淋巴干都都由胸导管收集（C错，为本题正确答案）。